真菌及其毒素污染粮豆类食物的最适宜环境条件是
A. 温度增加、湿度不变
B. 温度增加、湿度降低
C. 温度、湿度都增加
D. 温度、湿度都降低
E. 温度降低、湿度增加

正确答案：C。温度、湿度都增加

解析：本题考查真菌及其毒素污染粮豆类食物的最适宜环境条件。当环境温度增高、湿度较大时（C对ABDE错），真菌易在粮豆中生长繁殖，分解其营养成分并可能产生真菌毒素，引起粮豆霉变而导致粮豆的感官性状发生改变，营养和食用价值降低。